以下膀胱截石位中，肛裂的好发部位是
A. 10点
B. 4点
C. 6点
D. 2点
E. 8点

正确答案：C。6点

解析：绝大多数肛裂位于肛管的后正中线上，即截石位6点（C对）。